在中脑上、下丘之间切断动物脑干，可出现
A. 脊休克
B. 去大脑僵直
C. 昏睡不醒
D. 站立不稳
E. 运动共济失调

正确答案：B。去大脑僵直